肝主疏泄的基本生理功能是
A. 调畅情志活动
B. 调畅全身气机
C. 促进脾胃运化
D. 促进血行和津液代谢
E. 调节月经和精液的排泄

正确答案：B。调畅全身气机

解析：本题考查肝主疏泄的基本生理功能，属于理解记忆内容。肝主疏泄，是指肝气具有疏通、畅达全身气机，进而促进精血津液的运行输布、脾胃之气的升降、胆汁的分泌排泄以及情志的舒畅等作用，所以肝主疏泄的基本生理功能是调畅全身气机（B对）。